下列关于梅毒的传染方式，错误的是
A. 梅毒患者是唯一的传染源
B. 性接触是主要的传染方式
C. 输血可传染梅毒
D. 接吻、哺乳不会传染
E. 接触梅毒患者污染的器物等可被传染

正确答案：D。接吻、哺乳不会传染